患者，女性，40岁。因风湿性心脏病出现心衰，心功能Ⅱ级，并有下肢水肿，经地高辛治疗后，心功能有改善，但水肿不见好转，检查发现：血浆醛固酮水平高，此时最好选用
A. 呋塞米
B. 氢氯噻嗪
C. 螺内酯
D. 布美他尼
E. 氨苯蝶啶

正确答案：C。螺内酯